患者突然昏仆，不省人事，牙关紧闭，两手握固，大小便闭，肢体强痉，伴有静卧不烦，四肢不温，痰涎壅盛，舌苔白腻，脉沉滑缓。其诊断是
A. 中风  阳闭证
B. 中风  阴闭证
C. 中风  脱证
D. 中风  中经络
E. 中风  后遗症

正确答案：B。中风  阴闭证

解析：患者以突然昏仆，不省人事为主诉，故诊断为中风、中脏腑；患者四肢不温，痰涎壅盛，舌苔白腻，脉沉滑缓，为阴闭的表现症状，故诊断为中风 阴闭证。（B对）阳闭为瘀热痰火之象，如身热面赤、气粗鼻鼾、痰声如拽锯、便秘溲黄、躁扰不宁、舌苔黄腻、脉象弦滑而数。（A错）中风分为中经络和中脏腑，中经络者虽有半身不遂、口眼歪斜、语言不利，但意识清楚，中脏腑者昏不知人，或神志昏糊、迷蒙，伴见肢体不用，中脏腑需辨闭证与脱证，闭证属实，症见神志昏迷、牙关紧闭、口噤不开、两手握固、肢体强痉等，脱证属虚，乃为五脏真阳散脱于外，症见昏愦无知、目合口开、四肢松懈瘫软、手撒肢冷汗多、二便自遗、鼻息低微，为中风危候，（CD错）。中风后遗症是指发病半年以上，可见半身不遂、口歪、语言謇涩或失音等，本病例为急性起病（E错）。